关于成人牙釉质描述哪项是正确的
A. 有基于细胞活动上的防御机制
B. 能通过细胞修复达到自愈
C. 能进行诸如糖酵解等的生命活动
D. 能进行重要的物理-化学交换反应
E. 能对微生物的入侵产生炎症反应

正确答案：D。能进行重要的物理-化学交换反应

解析：本题考查成人牙釉质。釉质矿化过程中，氟离子进入磷灰石晶体中，与其HCO₃⁻和OH⁻等发生置换反应（D对），使釉质更加稳定，从而增强抗龋能力。釉质为无细胞结构，牙髓牙本质复合体有基于细胞活动的防御机制（A错），在受到长期较弱的外界刺激时，可形成修复性牙本质，隔绝外界刺激（B错）；微生物侵入牙本质后，可引发牙髓炎症反应（E错）。糖酵解过程是在菌斑中进行的（C错）。